动脉血压突然升高时，能引起
A. 窦神经传入冲动减少
B. 心迷走中枢抑制
C. 心迷走中枢兴奋
D. 交感缩血管中枢兴奋
E. 心交感中枢兴奋

正确答案：C。心迷走中枢兴奋